足月儿每日钠的需要量约是
A. 0.5～0.9mmol/kg
B. 1～2mmol/kg
C. 3～4mmol/kg
D. 5～6mmol/kg
E. 7～8mmol/kg

正确答案：B。1～2mmol/kg

解析：1～2mmol/kg（B对）即为足月儿每日钠的需要量。